从五行之间的关系来看，培土生金法的依据是
A. 五行相生
B. 五行相克
C. 五行相侮
D. 五行相乘
E. 五行胜复

正确答案：A。五行相生

解析：培土生金法是健脾生气以补益肺气的治法，脾生肺是五行相生的关系。主要用于脾气虚衰，生气无源，以至肺气虚弱之证（A对）。依据五行相克规律（B错）确定的治法常用的有抑木扶土法、培土制水法、佐金平木法和泻南补北法。